男，40岁。因塌方右腰部被砸伤，伤后出现大量肉眼血尿，右肾区明显肿胀，压痛，皮下可见淤血斑，脉搏120次/min，BP80/50mmHg。印象诊断是
A. 挫伤
B. 实质损伤
C. 实质与肾盂肾盏破裂
D. 全层裂伤
E. 肾蒂断裂

正确答案：D。全层裂伤

解析：本例患者为中年男性，有右腰部外伤的病史，伤后出现明显肉眼血尿、右肾区明显肿胀、压痛，脉搏细速、血压下降，提示有休克征象，印象诊断是右肾全层裂伤（D对）。肾挫伤（A错）患者临床表现多为镜下血尿，一般无肉眼血尿，且不会有休克征象。肾实质损伤（B错）患者多有慢性肾脏疾病病史，病程较长，与本例患者急性起病的情况不符。肾实质与肾盂肾盏破裂患者（C错）临床表现以肉眼血尿和尿外渗为主，因肾包膜完整，故一般无肾区明显肿胀等典型的肾周血肿症状。肾蒂断裂（E错）患者临床表现主要为大出血、休克，也可出现肉眼血尿、肾区肿胀、压痛等典型的肾周血肿症状，因肾蒂断裂在临床上较肾全层裂伤少见，故不优先考虑。